植物性食物中的维生素B₆主要是
A. 吡哆醛
B. 吡哆醇
C. 吡哆胺
D. PLP
E. PMP

正确答案：B。吡哆醇